痫病发生的主要病理基础为何脏的损伤
A. 肺、脾、肾
B. 心、肝、肾
C. 肝、脾、肾
D. 肺、肝、肾
E. 心、肝、脾

正确答案：C。肝、脾、肾

解析：痫病的基本病机为脏腑失调，痰浊阻滞，气机逆乱，风痰内动，蒙蔽清窍。病理因素主要有风、火、痰、瘀，又以痰为重要。本病的病位在脑，涉及肝、脾、心、肾诸脏。其中肝、脾、肾的损伤是痛病发生的主要病理基础（C对）。病理性质属于本虚标实，本虚为脏腑受损，标实为风、火、痰、瘀，四者并非孤立致病，多是互相结合、互相影响而发病根据新执业医师大纲，其肝、脾、肾的损伤是痫证发生的病理基础。